cn/ci=pKa-pH（cn：非离子型；ci：离子型）的意义描述正确的是
A. 说明与非离子型浓度对数成反比
B. 当pKa越大，pH越小，有机酸越易吸收
C. 当pKa越小，pH越大，有机酸越易吸收
D. 对某种物质来讲pKa值容易受体液环境的影响
E. 以上都对

正确答案：B。当pKa越大，pH越小，有机酸越易吸收